患者，女。宫颈癌术后5天，突发下肢肿胀，伴胀痛。确诊意义的检查是
A. 深静脉通畅试验阴性
B. 下肢静脉造影
C. 放射性核素检查
D. 超声检查
E. 多排CT

正确答案：B。下肢静脉造影

解析：女性患者，宫颈癌术后5天（提示患者存在术后血液高凝状态、卧床使血流缓慢），突发下肢肿胀，伴胀痛（下肢深静脉血栓形成常表现为下肢突然发生的肿胀、伴有胀痛、浅静脉扩张、局部压痛明显、局部皮温及体温均升高）。综合患者病史及症状体征，初步诊断为：下肢深静脉血栓形成。下肢静脉造影（B对）显示造影剂在静脉某一平面突然受阻的征象、充盈缺损等征象时，提示患者有下肢深静脉血栓形成，为下肢深静脉血栓形成的确诊检查。深静脉通畅试验是识别下肢深静脉是否通畅的试验方法，深静脉通畅试验阴性（A错）提示下肢深静脉通畅。放射性核素检查（C错）多用于肿瘤诊断，如临床上甲状腺肿瘤、肝肿瘤、骨肿瘤、脑肿瘤及大肠癌等。下肢超声检查（D错）可用于确定下肢深静脉主干是否阻塞，但不如下肢静脉造影直接可靠。多排CT（E错）因其价格昂贵且诊断价值不高，不作为首选检查。